在临床诊疗或开展以人为研究对象的医学研究时，首先应坚持
A. 知情同意原则
B. 保守秘密原则
C. 互相协作原则
D. 诚实原则
E. 公正原则

正确答案：A。知情同意原则

解析：人体实验必须经过受试者知情同意。受试者享有知情同意权，知情同意原则（A对）是人体实验进行的前提。在临床诊疗或开展以人为研究对象的医学研究时，应坚持的伦理原则：①必须具有正当目的；②经过受试者的知情同意；③合理保护受试者利益的原则；④恪守严谨的学风。